紫外线杀菌的原理是
A. 破坏细菌细胞壁肽聚糖结构
B. 使菌体蛋白变性凝固
C. 干扰DNA正常碱基配对
D. 影响细胞膜通透性
E. 与细菌核蛋白结合

正确答案：C。干扰DNA正常碱基配对

解析：紫外线杀菌的原理是使细菌DNA链上相邻的嘧啶碱基形成嘧啶二聚体，从而干扰DNA正常碱基配对，导致细菌死亡或突变。掌握“消毒与灭菌”知识点。